三部脉分候脏腑，左寸候是
A. 肾
B. 肺
C. 脾
D. 肝
E. 心

正确答案：E。心

解析：本题考查三部脉分候脏腑的概念。三部脉分候脏腑，左寸候是心（E对）。寸口脉分候脏腑：关于三部脉分候脏腑的问题，历代论说颇多，但基本精神是一致的。现临床常用的划分方法是：右寸候肺（B错），右关候脾（C错）胃，右尺候肾（A错）（命门）；左寸候心，左关候肝（D错），左尺候肾。总的来说是体现了“上（寸脉）以候上（躯体上部），下（尺脉）以候下（躯体下部）”的原则，这在临床上有一定的参考意义，但也不能把三部候脏腑的方法机械地看待，临床诊断时需结合具体的病证综合各方面情况加以分析，才能得出比较正确的诊断。当然，寸口脉搏亦最易切按，这也是诊脉独取寸口的原因之一。